既杀虫消积,又润肺止咳的药是
A. 榧子
B. 使君子
C. 南瓜子
D. 苦楝皮
E. 牵牛子

正确答案：A。榧子

解析：榧子的功效是杀虫消积，润肠通便，润肺止咳（A对）。使君子的功效是杀虫消积（B错）南瓜子的功效是杀虫（C错）。苦楝皮的功效是杀虫，疗廯（D错）。牵牛子的功效是泻下逐水，去积杀虫（E错）。